血小板输注禁忌症
A. 化疗导致的血小板减少
B. 血小板功能障碍
C. 大量输注悬浮红细胞稀释血小板減少
D. 血栓性血小板减少性紫瘢
E. 放疗导致的血小板减少

正确答案：D。血栓性血小板减少性紫瘢

解析：血栓性血小板减少性紫瘢（八版内科学P616）是一种较少见的弥散性微血管血栓-出血综合征，患者血管性血友病因子裂解酶缺乏或活性降低，不能正常降解超大分子血管性血友病因子，聚集的血友病因子促进血小板黏附与聚集，在微血管内形成血小板血栓，血小板消耗性减少，继发出血，微血管管腔狭窄，红细胞破坏，受累组织器官损伤或功能障碍。其治疗首选血浆置换，而不是输注血小板，因为血小板输注可促进血栓形成，使病情恶化（D对）。化疗导致的血小板减少（A错）、血小板功能障碍（B错）、大量输注悬浮红细胞稀释血小板減少（C错）、放疗导致的血小板减少（E错）均为血小板数目减少或功能障碍，可通过输注血小板治疗。